两样本均数比较（双侧）的t检验，检验统计量t=1.45，α=0.05，统计推断为
A. 两样本均数的差别有显著性
B. 两总体均数的差别有显著性
C. 两样本均数的差别无显著性
D. 两总体均数的差别无显著性
E. 本题未给出自由度，所以还不能推断

正确答案：D。两总体均数的差别无显著性